男性，40岁。因发热，便秘，食欲不振12天入院。查体：肝大，肋下1cm，软，脾肋下一指。血常规WBC2.7×10⁹/L，中性粒细胞52%，淋巴细胞44%，血清ALT120U/L，肥达反应：“O”1：160，“H”l：160。该患者最可能的诊断
A. 急性肝炎
B. 伤寒
C. 急性白血病
D. 败血症
E. 恶性组织细胞病

正确答案：B。伤寒

解析：患者持续发热、便秘、肝脾肿大，白细胞3.2×1012/L（成人正常参考值4～10×10⁹/L）减少，肥大试验阳性，故该患者最可能的诊断为伤寒。急性肝炎（P28）（A错）起病急，ALT显著升高。急性白血病（C错）白细胞增高，肥大试验阴性。败血症（P225）（D错）有高热，白细胞及中性粒细胞均增高。恶性组织细胞病（E错）全血细胞减少，可见异型组织细胞。